肾绞痛病人常采取的体位是
A. 强迫侧卧位
B. 角弓反张位
C. 强迫俯卧位
D. 强迫坐位
E. 辗转体位

正确答案：E。辗转体位

解析：体位是指患者身体所处的状态，体位的改对某些疾病的诊断具有一定的意义。辗转体位（E对）：患者辗转反侧，坐卧不安，见于胆石症、胆道蛔虫症、肾绞痛等。强迫侧卧位（A错）：有胸膜疾病的患者多采取患侧卧位，可限制患侧胸廓活动而减轻疼痛和有利于健侧代偿呼吸，见于一侧胸膜炎和大量胸腔积液的患者。角弓反张（B错）：患者颈及脊背肌肉强直，出现头向后仰，胸腹前凸，背过伸，躯干呈弓形，见于破伤风及小儿脑膜炎。强迫俯卧位（C错）：俯卧位可减轻脊背肌肉的紧张程度，见于脊柱疾病。强迫坐位（D错）：亦称端坐呼吸，患者坐于床沿上，以两手置于膝盖或扶持床边，该体位便于辅助呼吸肌参与呼吸运动，加大膈肌活动度，增加肺通气量，并减少回心血量和减轻心脏负担，见于心、肺功能不全者。